清创术缝合的基本原则是
A. 先缝合、关闭与口、鼻腔和上颌窦等腔窦相通的创口
B. 对裸露的骨面应争取用软组织覆盖
C. 创口较深者要分层缝合，消灭死腔
D. 面部创口的缝合要用小针细线，创缘要对位平整
E. 以上均是

正确答案：E。以上均是

解析：本题考查清创术缝合的基本原则。外科清创处理和早期缝合伤口是预防创口感染和促进组织愈合的基本方法。缝合创口时其原则包括：①缝合创口时，要先关闭与口、鼻腔和上颌窦等腔窦相通的创口（A对）。②对裸露的骨面应争取用软组织覆盖（B对）。③创口较深者要分层缝合，消灭无效腔（C对）。④面部皮肤的缝合要用小针细线，创缘要对位平整（D对），缝合后创缘要略外翻；应细致缝合唇、鼻、眼睑等部位。（ABCD均对，故E为本题的正确答案）。